翼下颌间隙感染主要表现为
A. 眶下区弥漫性水肿
B. 以下颌角为中心的红肿
C. 先有牙痛史，继之出现张口受限
D. 颌下三角区红肿
E. 颌下、口底广泛水肿

正确答案：C。先有牙痛史，继之出现张口受限

解析：本题考查翼下颌间隙、颞下间隙感染。翼下颌间隙感染常是先有牙痛史，继之出现开口受限（C对），咀嚼、吞咽疼痛。口腔检查见翼下颌皱襞处黏膜水肿，下颌支后缘稍内侧可有轻度肿胀、深压痛。